女性，35岁。近2个月来发热，乏力伴消瘦。体检：左颈、二侧腋窝和腹股沟部位可触及数个黄豆和蚕豆大小淋巴结，肝未及，脾肋下3cm，红细胞4.0✕10¹²/L，血红蛋白12g/L，白细胞5.6✕10⁹/L，血小板150✕10⁹/L，血沉80mm/h。本病例首选的治疗方案是
A. α干扰素
B. 手术切除
C. 放疗治疗
D. 化学治疗
E. 大剂量丙种球蛋白静脉滴注

正确答案：D。化学治疗